患者，女，58岁，高血压病史3年，服用氨氯地平控制血压。近1月来间断上腹痛，伴反酸，诊断为胃溃疡，Hp（+），给予雷贝拉唑、克拉霉素、阿莫西林、枸橼酸铋钾进行Hp根除治疗。服药后患者自述舌苔发黑，口中有氨味，可能引起这种现象的药物是
A. 雷贝拉唑
B. 克拉霉素
C. 枸橼酸铋钾
D. 阿莫西林
E. 氨氯地平

正确答案：C。枸橼酸铋钾

解析：本题考查枸橼酸铋钾的不良反应。枸橼酸铋钾（C对）可引起口中有氨味、舌苔及大便呈灰黑色、便秘等，停药后可自行消失。